新斯的明的药理作用是
A. 抑制胆碱酯酶
B. 阻断M胆碱受体
C. 阻断N胆碱受体
D. 激动α肾上腺素受体
E. 阻断β肾上腺素受体

正确答案：A。抑制胆碱酯酶